胃小弯最低点弯度明显折转处是
A. 中间沟
B. 贲门切迹
C. 幽门
D. 贲门
E. 角切迹

正确答案：E。角切迹

解析：胃小弯最低点弯度明显折转处是角切迹（E对）。胃与食管结合部称为贲门（D错），与十二指肠结合部称为幽门（C错）。